作用于EGFR靶点，属于酪氨酸激酶抑制剂的有
A. 埃克替尼
B. 尼洛替尼
C. 厄洛替尼
D. 克唑替尼
E. 奥希替尼

正确答案：A、C、E。埃克替尼；厄洛替尼；奥希替尼

解析：本题考查酪氨酸激酶抑制剂。埃克替尼（A对）、厄洛替尼（C对）、奥希替尼（E对）的作用靶点为EGFR。尼洛替尼（B错）的作用靶点为Bcr-Abl。克唑替尼（D错）的作用靶点为ALK/C-MET。